女，57岁，反复发作右侧脸颊及上唇剧痛，疼痛频繁，每次持续数秒钟，刷牙洗脸进食均可诱发，神经系统查体无异常。该患者最可能的诊断是
A. 丛集性头痛
B. 偏头痛
C. 三叉神经痛
D. 上颌窦炎
E. 面神经麻痹

正确答案：C。三叉神经痛

解析：女，57岁（三叉神经痛女性多见，49岁以上患者多见），反复发作右侧脸颊及上唇剧痛，疼痛频繁，每次持续数秒钟（三叉神经痛的表现），刷牙洗脸进食均可诱发（三叉神经痛的诱发因素），神经系统查体无异常（三叉神经痛的查体结果），结合患者的诱发因素，病史，表现和辅助检查，该患者最可能的诊断是三叉神经痛（C对）。（P179）丛集性头痛是一种原发性神经血管性头痛，表现为一侧眼眶周围发作性剧烈疼痛，有反复密集发作的特点，伴有同侧眼结膜充血、流泪、瞳孔缩小、眼脸下垂以及头面部出汗等自主神经症状，常在一天内固定时间发作，可持续数周至数月（A错）。（P174）偏头痛是临床常见的原发性头痛，其特征是发作性、多为偏侧、中重度、搏动样头痛，一般持续4～72 小时，可伴有恶心、呕吐，声、光刺激或日常活动均可加重头痛，处于安静环境、休息可缓解头痛（B错）。（P390）面神经麻痹通常急性起病，面神经麻痹在数小时至数天达高峰，主要表现为患侧面部表情肌瘫痪，额纹消失，不能皱额蹙眉，眼裂不能闭合或者闭合不全（E错）。以上四种疾病未出现反复发作右侧脸颊及上唇频繁剧痛的三叉神经痛表现，故除外。